关于药源性肝脏疾病的说法，错误的是
A. 药源性肝脏疾病是导致急性肝衰竭的主要原因之一
B. 多数药源性肝脏疾病有一定潜伏期
C. 用药期间过量饮酒会增加药源性肝脏疾病的发生风险
D. 药源性肝脏疾病的发生可预测
E. 不良药物相互作用可导致药源性肝脏疾病

正确答案：D。药源性肝脏疾病的发生可预测

解析：本题考查药源性肝脏疾病。药源性肝脏疾病又称药物性肝损伤（DILD），是最主要的药源性疾病之一，越来越引起医药界、制药业、药监管理部门及公众重视，成为药品审批失败、药物警戒以及撤市的主要原因。其是欧美国家急性肝衰竭（AHF）的主要原因（A对），而AHF已经成为欧美国家肝移植的重要原因之一。发生多具不可预测性（D错，为本题正确答案），住院患者约1%可发生药物性肝损伤，实际发生例数至少为报道的16倍。药物性肝损伤多有一定的潜伏期（B对），用药2周内发病者占50%～70%。